与动、静脉血栓形成及反复流产相关的自身抗体是
A. 抗SSA抗体
B. 抗核抗体
C. 抗Sm抗体
D. 抗dsDNA抗体
E. 抗心磷脂抗体

正确答案：E。抗心磷脂抗体

解析：抗心磷脂抗体（E对）主要引起凝血系统改变，临床上表现为动、静脉血栓形成、血小板减少和习惯性流产等。抗SSA抗体（A错）与SLE中出现光过敏、血管炎、皮损、白细胞减低、平滑肌受累、新生儿狼疮等相关。抗核抗体（B错）几乎见于所有的SLE患者，特异性低，它的阳性不能作为SLE与其他结缔组织病的鉴别。抗Sm抗体（C错）是诊断SLE的标记抗体之一。抗dsDNA抗体（D错）多出现在SLE的活动期，其滴度与疾病活动性密切相关。